以下有关聚羧酸锌粘固剂的论述中，不恰当的是
A. 对釉质和牙本质都有较大的黏着力
B. 能刺激修复性牙本质的形成
C. 可作为垫底材料
D. 聚羧酸锌粘固剂在唾液中的溶解度大于磷酸锌粘固剂
E. 对牙髓的刺激性较小

正确答案：B。能刺激修复性牙本质的形成

解析：聚羧酸锌粘固粉的抗压强度为53.9～73.5MPa，对釉质和牙本质都有较大的黏着力，对牙髓的刺激性较小，但不能刺激修复性牙本质的形成。聚羧酸锌粘固剂在唾液中的溶解度大于磷酸锌粘固剂，绝缘性能稍差。掌握“口腔材料的性能与选择、垫底与暂封材料”知识点。